其神经毒性常累及感觉神经末梢的药物是
A. 奥沙利铂
B. 异环磷酰胺
C. 伊立替康
D. 丝裂霉素
E. 氟尿嘧啶

正确答案：A。奥沙利铂

解析：本题考查奥沙利铂。奥沙利铂（A对）的神经毒性则比较特殊，常累及感觉神经末梢，表现为肢端麻木，面部、咽喉部感觉异常，遇冷刺激时加重，可导致喉部痉挛，甚至呼吸困难。环磷酰胺和异环磷酰胺（B错）可引起出血性膀胱炎，表现为尿频、排尿困难等尿道刺激症状，继而出现血尿，异环磷酰胺引起出血性膀胱炎的风险更高。伊立替康（C错）可引起腹泻。丝裂霉素（D错）可引起急性肾小管坏死。氟尿嘧啶（E错）可致心脏毒性。